女孩，9岁。发热伴咽痛2天，今日全身皮肤出现鲜红色粟粒疹，疹间皮肤充血，咽部充血明显，舌质红，舌状乳头明显突起于舌苔表面，腋下、肘窝可见帕氏线。最可能的诊断是
A. 猩红热
B. 水痘
C. 小儿急疹
D. 手足口病
E. 麻疹

正确答案：A。猩红热

解析：猩红热的皮疹特点是皮肤弥漫性充血，上有密集针尖大小丘疹，全身皮肤均可受累，疹退后伴脱皮（A对）。水痘皮疹特点为皮肤黏膜相继出现和同时存在斑疹、丘疹、疱疹和结痂等各类皮疹（B错）。麻疹的皮疹特点是红色斑丘疹，自头面部→颈→躯干→四肢，退疹后有色素沉着及细小脱屑（E错）。幼儿急诊的皮疹特点是红色细小密集斑丘疹，头面颈及躯干部多见，四肢较少，一天出齐，次日即开始消退（C错）。手足口病的皮疹特点是手、足、口、臀等部位可见散发性的皮疹和疤疹，偶见于躯干（D错）。